女性，38岁，糖尿病12年，每日皮下注射人混合胰岛素治疗，早餐前30单位，晚餐前24单位，每日进餐规律，主食量300g。近来空腹血糖12.5mmol/L，餐后血糖7.6～9.0mmol/L。最可能的情况是
A. somogyi或黎明现象
B. 晚餐主食过多或过少
C. 未加口服降糖药物
D. 餐后血糖控制不住
E. 存在胰岛素抵抗

正确答案：A。somogyi或黎明现象

解析：患者规律使用胰岛素替代治疗与饮食治疗后出现空腹高血糖，餐后血糖控制尚可，最可能的原因为夜间出现低血糖继发的反跳性高血糖或由于清晨升糖激素增多引起的高血糖即Somogyi效应或黎明现象（A对）。患者每日规律饮食且餐后血糖控制尚可，因此晚餐主食过多或较少（B错）引起空腹低血糖的均可能性不大。患者餐后血糖控制尚可，无加用口服降糖药物的必要（C错）。患者餐后血糖（D错）控制在理想范围内（≤10.0mmol/L，P735）。患者使用常规剂量胰岛素后餐后血糖控制佳，说明对于胰岛素敏感，而非抵抗（E错）。